对慢性砷中毒病人有效的解毒剂是
A. 硫代硫酸钠
B. 依地酸二钠
C. 二巯基丙磺酸钠
D. 氨基磺酸钠
E. 碳酸氢钠

正确答案：C。二巯基丙磺酸钠

解析：本题考查对慢性砷中毒病人有效的解毒剂。地方性砷中毒是由于长期自饮用水、室内煤烟、食物等环境介质中摄入过量的砷而引起的一种生物地球化学性疾病。对慢性砷中毒病人有效的解毒剂是二巯基丙磺酸钠（C对ABDE错），每天肌肉注射0.125～0.25g，每3～5天为一疗程，视尿砷浓度变化决定用药期限。